近年来临床输血中细菌污染反应增多的最主要原因是
A. 输血时未严格按无菌操作规程要求操作
B. 塑料输血袋本身污染细菌
C. 血小板在体外保存于室温，细菌相对容易生长繁殖
D. 血液成分分离制备时操作不当导致污染细菌
E. 采血时皮肤消毒不严

正确答案：D。血液成分分离制备时操作不当导致污染细菌

解析：输血后引起的细菌污染反应，主要由于采血、储存环节中无菌技术有漏洞而造成的。近年来，血液制品的采集及输注逐渐规范，采血时皮肤消毒不严（E错）、塑料输血袋本身污染细菌（B错）、输血时未严格按无菌操作规程要求操作（A错）等技术性问题较少出现。而血液成分分离制备操作步骤及涉及到的容器较多，操作不当易导致细菌污染（D对）。血小板制剂一般用于再障性贫血和各种血小板低下的病人，在临床上应用少于常规的血液制品，因此不作为细菌污染反应的最主要原因（C错）。